临床骶管麻醉时确定骶管裂孔的标志是
A. 骶岬
B. 骶角
C. 骶前孔
D. 骶后孔
E. 无

正确答案：B。骶角

解析：骶前（C错）、后孔（D错）均与骶管相通，骶管上通连椎管，下端的裂孔称骶管裂孔,裂孔两侧有向下突出的骶角，骶管麻醉常以骶角（B对）作为标志。